釉质表层氟含量较深层
A. 相同
B. 低1～5倍
C. 低5～10倍
D. 高5～10倍
E. 高1～5倍

正确答案：D。高5～10倍

解析：牙的氟蓄积与骨基本相似。也是随着年龄和摄氟量的增加而增加。个体牙氟含量相对低于其骨氟含量。氟在牙形成、矿化以及矿化后进入牙组织，釉质氟主要聚积在表层，釉质表层较深层高5～10倍。牙本质的氟浓度介于表层和深层釉质之间。掌握“人体氟摄入及代谢、氟防龋”知识点。